新生儿各种细胞吞噬功能
A. 成熟
B. 增强
C. 暂时增强
D. 减低
E. 暂时减低

正确答案：E。暂时减低

解析：新生儿非特异性免疫和特异性免疫均不成熟。皮肤黏膜薄嫩易损伤；脐残端未完全闭合，离血管近，细菌易进入血液；呼吸道纤毛运动差，胃酸、胆酸少，杀菌力差；同时分泌型IgA缺乏，易发生呼吸道和消化道感染。血浆中补体水平低，调理素活性低，多形核白细胞产生及储备均少，且趋化性及吞噬能力低下（E对），机体免疫应答低下或迟缓，易患细菌感染。